糖尿病肾病大量蛋白尿患者应给予
A. 糖皮质激素
B. 磷结合剂
C. 促红细胞生成素
D. 血管紧张素转换酶抑制剂
E. 碳酸氢钠

正确答案：D。血管紧张素转换酶抑制剂

解析：糖尿病肾病为常见的糖尿病微血管病变，早期主要表现为微量白蛋白尿，晚期可出现大量白蛋白尿。血管紧张素转换酶抑制剂（D对）可通过抑制血管紧张素的作用，舒张出球小动脉，降低肾小球内压和肾小球滤过，减少尿蛋白，保护肾功能。糖皮质激素（A错）通过抑制免疫反应，影响肾小球基底膜通透性等作用减轻蛋白尿（P475），一般用于原发性肾脏疾病的治疗。磷结合剂（B错）主要用于慢性肾衰竭高磷血症的治疗（P525）。促红细胞生成素（C错）一般用于纠正慢性肾衰竭患者继发的肾性贫血。碳酸氢钠（E错）一般用于纠正严重代谢性酸中毒。